不属于子宫内膜异位症临床特征的是
A. 痛经
B. 白带过多
C. 持续下腹痛
D. 不孕
E. 月经失调

正确答案：B。白带过多

解析：子宫内膜异位症的临床表现为1.痛经及下腹痛（AC对），主要症状是痛经，特点为继发性痛经，进行性加剧，疼痛多位于下腹部及腰骶部，可放射至阴道、会阴、肛门或大腿，发生在经前及经期，也有出现在经净后，呈周期性；2.月经失调（E对），15%-30%患者表现为经量增多、经期延长或经前点滴出血；3.不孕（D对），本病的发生率为40%；4.性交痛，病变累及直肠子宫陷凹、宫骶韧带，或因局部粘连导致子宫后倾固定，性交时宫颈受到碰撞及子宫的收缩和向上提升可引起疼痛，且以经前为著；5.肠道子宫内膜异位症可出现腹痛、腹泻、便秘，甚至周期性少量便血，严重者可压迫肠腔引起肠梗阻（B错，为本题正确答案）。